属于人体骨骼中最活跃的部分，具有高度可塑性的是
A. 上颌骨
B. 腭骨
C. 骨骺端
D. 牙槽骨
E. 软骨

正确答案：D。牙槽骨

解析：牙槽骨是高度可塑性组织，也是人体骨骼最活跃的部分。掌握“牙槽骨”知识点。